肝硬化出血倾向的主要原因是
A. 维生素缺乏
B. 血小板功能不良
C. 凝血因子减少
D. 毛细血管脆性增加
E. 肝脏解毒功能下降

正确答案：C。凝血因子减少

解析：肝硬化出血倾向的主要原因为肝脏合成凝血因子减少（C对），其次为血小板数量减少及功能异常（B错）、抗凝物质增多、纤维蛋白溶解增加、毛细血管渗透脆性增加（D错）、弥漫性血管内凝血。而维生素缺乏（A错）及肝脏解毒功能下降（E错）与肝硬化出血倾向无关。